治疗癃闭、遗尿的穴位是
A. 太冲
B. 大陵
C. 神门
D. 内关
E. 阴郄

正确答案：A。太冲

解析：该题考查太冲穴的主治病证。太冲穴主治中风、癫狂痫、小儿惊风；头痛眩晕、耳鸣、目赤肿痛、口歪、咽痛等肝经风热病证；月经不调、痛经、闭经、崩漏、带下等妇科经带病证；黄疸、胁痛、腹胀、呕逆等肝胃病证；癃闭、遗尿；下肢痿痹，足跗肿痛（A对）。大陵穴主治心痛，心悸，胸胁满痛；胃痛、呕吐、口臭等胃腑病证；喜笑悲恐、癫狂痫等神志疾患；臂、手挛痛（B错）。神门穴主治心痛、心烦、惊悸、怔忡、健忘、失眠、痴呆、癫狂痫等心与神志病证；高血压；胸胁痛（C错）。内关穴主治心痛、胸闷、心动过速或心动过缓等心疾；胃痛、呕吐、呃逆等胃腑病证；中风；失眠、郁证、癫狂痫等神志病证；眩晕症，如晕车、晕船、耳源性眩晕；肘臂挛痛（D错）。阴郄主治心痛、惊悸等心病；骨蒸盗汗；吐血，衄血（E错）。